一肝炎患者作肝穿刺活检，镜下见肝细胞点状坏死，汇管区见少量淋巴细胞浸润及轻度纤维组织增生，肝小叶结构完整。上述病变符合
A. 急性普通型肝炎
B. 轻度慢性肝炎
C. 中度慢性肝炎
D. 重度慢性肝炎
E. 早期肝硬化

正确答案：B。轻度慢性肝炎

解析：镜下见肝细胞点状坏死，汇管区见少量淋巴细胞浸润及轻度纤维组织增生，肝小叶结构完整为轻度慢性肝炎（B对）的病变特点。急性普通型肝炎（A错）（P198）镜下主要见点状坏死与嗜酸性小体，肝细胞坏死轻微，肝小叶内与汇管区可见轻度炎细胞浸润。中度慢性肝炎（C错）（P198）镜下主要见肝细胞变性、坏死较明显，中度碎片状坏死，出现特征的桥接坏死，小叶内有纤维间隔形成。重度慢性肝炎（D错）（P198）镜下主要见重度碎片状坏死和大范围的桥接坏死，纤维间隔分割肝小叶结构。早期肝硬化（E错）（P201）镜下主要见假小叶形成。